休克情况下，提示暂不补钾的尿量指标是
A. 每小时40mL
B. 每小时60mL
C. 每小时80mL
D. 每小时100mL
E. 每小时120mL

正确答案：A。每小时40mL

解析：补钾的原则有尿多补钾，在休克、脱水、缺氧、酸中毒、肾衰竭等未纠正前，尿量＜40mL/h（A对）或24小时尿量少于5OOmL，暂不补钾。